因肺结核引起的支气管扩张，湿啰音最常见的部位是
A. 肺底部
B. 肺尖部
C. 腋窝部
D. 肩胛间区
E. 双肺弥漫

正确答案：D。肩胛间区

解析：肺结核引起的支气管扩张好发于上叶尖后段，若发生感染，则于肩胛间区（D对）可闻及湿啰音。肺底部（A错）啰音常见于肺炎、心衰等疾病，不具有特异性。肺尖部（B错）湿啰音常见于继发性肺结核。腋窝部湿啰音对疾病的诊断没有特异性（C错）。双肺弥漫性（E错）湿啰音常见于ARDS、急性左心衰等疾病。